太息多因
A. 肺失宣降
B. 肺气不足
C. 脾气虚弱
D. 肝气郁结
E. 肾不纳气

正确答案：D。肝气郁结

解析：太息又称叹息，是患者情志抑郁，胸闷不畅时发出的长吁或短叹声，常是情志不遂，肝气郁结的表现（D对）。肺失宣降，表现为咳嗽，水肿，痰多，喘满等症（A错）。肺气不足，表现为咳喘无力，气短，动则益甚，痰液清稀，声音低怯，神疲体倦，面色㿠白，畏风自汗，舌淡苔白，脉虚（B错）。脾气虚弱，表现为脘腹胀满，食后为甚，口不知味，甚至不思饮食，大便溏薄，精神不振，形体消瘦，肢体倦怠，少气懒言，面色萎黄或白，或肢体浮肿（C错）。肾不纳气，表现为见气短，气喘，动则喘甚而汗出，呼多吸少等吸气困难表现，面虚浮，脉细无力或虚浮无根（E错）。